关于注射用A型肉毒毒素管理的说法，正确的是
A. 只有药品零售连锁企业才能经营注射用A型肉毒毒素，非连锁药品零售企业不得经营
B. 注射用A型肉毒毒素只能销售至已取得《医疗机构执业许可证》的医疗美容机构
C. 调配注射用A型肉毒毒素的处方应保存3年备查
D. 经营注射用A型肉毒毒素的药品批发企业应具有医疗用毒性药品经营资质和生物制品经营资质

正确答案：D。经营注射用A型肉毒毒素的药品批发企业应具有医疗用毒性药品经营资质和生物制品经营资质

解析：本题考查A型肉毒毒素的管理。关于注射用A型肉毒毒素管理的说法，正确的是经营注射用A型肉毒毒素的药品批发企业应具有医疗用毒性药品经营资质和生物制品经营资质（D对）。A型肉毒毒素的管理：为加强对A型肉毒毒素的监督管理，原国家食品药品监督管理局、原卫生部发布《关于将A型肉毒毒素列入毒性药品管理的通知》（国食药监办〔2008〕405号），决定将A型肉毒毒素及其制剂列入毒性药品管理。2016年6月24日，国家食品药品监督管理总局办公厅发布《关于加强注射用A型肉毒毒素管理的通知》（食药监办药化监〔2016〕88号），要求药品生产经营企业切实加强注射用A型肉毒毒素购销管理，防止注射用A型肉毒毒素从合法渠道流入非法从事美容业务的机构，防止假药进入合法渠道。1.药品生产企业应制定A型肉毒毒素制剂年度生产计划，严格按照年度生产计划和药品GMP要求进行生产。注射用A型肉毒毒素生产（进口）企业应当指定具有医疗用毒性药品收购经营资质的药品批发企业作为本企业注射用A型肉毒毒素的经营企业，并且经指定的经营企业直接将注射用A型肉毒毒素销售至已取得《医疗机构执业许可证》的医疗机构或医疗美容机构（B错）。未经指定的药品经营企业不得购销注射用A型肉毒毒素。3.生产经营企业不得向未取得《医疗机构执业许可证》的单位销售注射用A型肉毒毒素；药品零售企业不得经营注射用A型肉毒毒素（A错）。4.注射用A型肉毒毒素生产（进口）企业和指定经营企业必须严格审核购买单位资质，建立客户档案，健全各项管理制度，加强购、销、存管理，保证来源清楚，流向可核查、可追溯。要建立注射用A型肉毒毒素购进、销售台账，并保存至超过药品有效期2年备查（C错）。5.注射用A型肉毒毒素生产（进口）企业应当及时将指定经营企业情况报所在地省级食品药品监管部门备案。药品生产（进口）企业所在地省级食品药品监管部门要对生产（进口）企业指定的经营企业进行审核，经审核确认的经营企业名单应当予以公布。